能单独应用化疗治愈的肿瘤是
A. 肾母细胞瘤
B. 霍奇金病
C. 绒毛膜上皮癌
D. 颗粒细胞白血病
E. 早期直肠癌

正确答案：C。绒毛膜上皮癌

解析：化学治疗是肿瘤的主要治疗手段之一。目前，部分肿瘤单独应用化疗即可治愈，如绒毛膜上皮癌（C对）、恶性葡萄胎、睾丸精原细胞瘤、Burkitt淋巴瘤、大细胞淋巴瘤、中枢神经系统淋巴瘤、急性淋巴细胞白血病等。肾母细胞瘤（A错）、霍奇金病（B错）、颗粒细胞白血病（D错）、乳癌、膀胱癌等应用化疗可使肿瘤获得缓解或是肿瘤缩小，或可使手术范围缩小以尽可能多地保留器官功能。早期直肠癌（E错）以手术切除为主要治疗方法，单独应用化疗不能治愈。